妊娠期妇女使用可致胎儿甲状腺功能低下的药品是
A. 氨基糖苷类
B. 氮芥类
C. 甲巯咪唑
D. 头孢菌素类
E. 胰岛素

正确答案：C。甲巯咪唑

解析：本题考查妊娠妇女用药注意事项。妊娠期妇女使用可致胎儿甲状腺功能低下的药品是甲巯咪唑（C对）。甲巯咪唑为抗甲状腺药，可抑制甲状腺激素的生物合成，可致胎儿甲状腺功能低下。氨基糖苷类（A错）抗生素的耳毒性会造成胎儿听神经受损而致永久性耳聋。烷化剂如氮芥类（B错）药物可引起泌尿生殖系异常，指趾畸形。头孢菌素（D错）应用于妊娠和哺乳期妇女虽尚未见发生问题，但仍需慎用。胰岛素（E错）在妊娠期应用时，应尽量使用生物合成的人胰岛素，动物源性的胰岛素不建议使用。